男4岁，因怀疑先天性心脏病就诊。首先去检查
A. 血常规
B. 脑电图
C. 血钙、磷测定
D. 胸部X线摄片
E. 腹部B超

正确答案：D。胸部X线摄片

解析：X线对先天性心脏病的诊断具有价格低廉、方法简便、辐射量小和易于复查的优点，因此对怀疑先天性心脏病的患儿，首先应去检查X线（D对）。血常规（A错）用于诊断白血病、贫血，败血症等，对先天性心脏病的诊断帮助不大。对先天性心脏病诊断有帮助的是心电图而不是脑电图（B错）。血钙磷测定一般用于诊断维生素D缺乏性佝偻病等，与先天性心脏病的诊断无关（C错）。腹部B超在儿科的用途是诊断肠套叠和先天性肥厚性幽门狭窄（E错）。